“垂腕症”是损伤了
A. 正中神经
B. 桡神经
C. 腋神经
D. 肌皮神经
E. 尺神经

正确答案：B。桡神经

解析：正中神经（A错）损伤表现为鱼际肌萎缩，手掌变平呈＂猿掌＂。桡神经（B对）损伤导致前臂伸肌群的瘫痪，表现为抬前臂时呈“垂腕”状。腋神经（C错）损伤表现为臂不能外展，肩部和臂外上部皮肤感觉障碍。肌皮神经（D错）损伤时表现为屈肘无力以及前臂外侧部皮肤感觉的减弱。尺神经（E错）损伤后掌指关节过伸，出现“爪形手”。